男，32岁，后背及双上臂沸水烫伤4小时，查体：T37.4℃，P100次/分，R20次/分，BP130/90mmHg，意识清楚，后背及双上臂背侧红肿明显，大量水疱，基底发红，疼痛明显。对该患者创面的处理措施正确的是
A. 干燥无菌纱布覆盖包扎
B. 70%酒精消毒创面
C. 剪除水疱的皮
D. 患肢包扎固定
E. 穿刺抽出水疱液

正确答案：E。穿刺抽出水疱液

解析：患者为浅Ⅱº烧伤，在进行创面处理时应先使用1：1000苯扎溴铵或1：2000氯己定（B错）清洗创周健康皮肤，移除异物，水疱皮应尽量给予保留（C错），水疱大者可用消毒针抽取水疱皮（E对）。如用纱布应用油质纱布，可添加适量抗生素，不应用干燥无菌纱布覆盖包扎（A错）。患肢包扎固定（D错）为入院前急救治处理。